甲状腺素的应用包括
A. 单纯性甲状腺肿
B. 甲状腺术前准备
C. 黏液性水肿
D. 呆小症
E. 甲状腺危象

正确答案：A、C、D。单纯性甲状腺肿；黏液性水肿；呆小症

解析：本题考查甲状腺素的作用。甲状腺激素主要用于甲状腺功能低下的替代治疗。1.呆小病（D对）；2.黏液性水肿（C对）；3.单纯性甲状腺肿（A对）；4.T₃抑制试验。甲状腺术前准备（B错）可用
硫脲类抗甲状腺药。甲状腺危象（C错）可用大剂量碘剂。